我国煤工尘肺是指
A. 煤矿工人患的矽肺
B. 煤肺
C. 煤矽肺
D. 煤肺＋煤矽肺
E. 煤矿工人患的矽肺＋煤肺＋煤矽肺

正确答案：E。煤矿工人患的矽肺＋煤肺＋煤矽肺

解析：本题考查煤工尘肺的概念。煤工尘肺是指煤矿作业工人长期吸入生产性粉尘所引起的尘肺的总称。尘肺的种类较多，岩石掘进工人接触岩石粉尘所患尘肺为矽肺；采煤工作面的工人主要接触单纯性煤尘所患尘肺为煤肺；既在岩石掘进工作面也在采煤工作面工作过的工人，所患尘肺为煤矽肺（E对ABCD错）。